衣服面料常见的污染物质主要是
A. 甲醛
B. 三氯乙烯
C. 芳香胺类
D. 有机汞
E. 消毒剂

正确答案：A。甲醛

解析：本题考查衣服面料常见的污染物质。衣服面料常见的污染物质主要是甲醛（A对BCDE错），我国在纺织品和服装产品标准中制定了控制甲醛含量的指标，并于2003年3月1日开始执行强制性国家标准《纺织品甲醛含量的限定》（GB 18401-2001），其中规定婴幼儿纺织品甲醛含量不得超过20mg/kg；接触皮肤的服装甲醛含量不得超过75mg/kg；不接触皮肤的服装甲醛含量不得超过300mg/kg。